开展膳食与糖尿病关系的病例对照研究，若选用确诊一年以上的糖尿病患者作为病例组，则最常见的偏倚是
A. 入院率偏倚
B. 不依从偏倚
C. 回忆偏倚
D. 失访偏倚
E. 现患病例-新发病例偏倚

正确答案：E。现患病例-新发病例偏倚

解析：本题中条件是选用确诊一年以上的糖尿病患者，忽视了新发病例的数据，易产生现患病例-新发病例偏倚（E对）。另外，现患病例（即确诊一年以上的糖尿病患者）还存在患病后改变了原有的某些暴露情况（改善了原有的膳食状况），从而导致因素与疾病关系的误差也称为现患病例-新发病例偏倚（E对）。采用医院病人作为研究对象的病例对照研究易发生入院率偏倚（A错）：回忆偏倚（C错）是指在病例对照研究、回顾性队列研究中、研究对象回忆不真实所造成的偏倚：失访偏倚（D错）常常是由于观察时间过长，而出现的数据追踪丢失造成的偏倚。不依从偏倚（B错）的说法不规范。